普通口服片应检查
A. 融变时限
B. 崩解时限
C. 溶散时限
D. 溶化性
E. 软化点

正确答案：B。崩解时限

解析：本题考查片剂的质量要求。普通口服片应检查崩解时限（B对）。片剂崩解时限：除另有规定外，药材原粉片6片均应在30分钟内全部崩解；浸膏（半浸膏）片、糖衣片各片均应在1小时内全部崩解。薄膜衣片在盐酸溶液（9→1000）中检查，化药片应在30分钟内全部崩解；中药片应在1小时内全部崩解。含片的溶化性照崩解时限检查法检查，各片均不应在10分钟内全部崩解或溶化。舌下片各片均应在5分钟内全部崩解并溶化。可溶片各片均应在3分钟内全部崩解并溶化。口崩片应在60秒内全部崩解并通过筛孔内径为710㎛的筛网。肠溶片先在盐酸溶液（9→1000）中检查2小时，每片均不得有裂缝、崩解或软化现象，再在磷酸盐缓冲液（pH6.8）中进行检查，1小时内应全部崩解。结肠定位肠溶片照各品种项下规定检查，各片在盐酸溶液（9→1000）及pH6.8以下的磷酸盐缓冲溶液中均应不得有裂缝、崩解或软化现象，在pH7.5～8.0的磷酸盐缓冲液中1小时内应完全崩解。泡腾片置盛有200ml水（水温为20℃±5℃）的烧杯中，有许多气泡放出，当片剂或碎片周围的气体停止逸出时，片剂应溶解或分散在水中，无聚集的颗粒剩留，除另有规定外，各片均应在5分钟内崩解。咀嚼片、以冷冻干燥法制备的口崩片以及规定检查溶出度、释放度的片剂，一般不再进行崩解时限检查。片剂融变时限（A错）：阴道片应检查融变时限。除另有规定外，阴道片3片，均应在30分钟内全部溶化或崩解溶散并通过开孔金属圆盘，或仅残留少量无硬心的软性团块。丸剂溶散时限（C错）：除另有规定外，小蜜丸、水蜜丸和水丸应在1小时内全部溶散；浓缩丸和糊丸应在2小时内全部溶散；滴丸应在30分钟内全部溶散，包衣滴丸应在1小时内全部溶散。蜡丸照崩解时限检查法片剂项下的肠溶衣片检查法检查，在盐酸溶液中（9→1000）检查2小时，不得有裂缝、崩解或软化现象，再在磷酸盐缓冲液（pH6.8）中检查，1小时内应全部崩解。除另有规定外，大蜜丸及研碎、嚼碎后或用开水、黄酒等分散后服用的丸剂不检查溶散时限。颗粒剂溶化性（D错）：可溶性颗粒，取供试品10g（中药单剂量包装取1袋）加20倍量热水搅拌5分钟，可溶颗粒应全部溶化，允许有轻微浑浊。泡腾颗粒，取供试品3袋，分别置盛有200ml水的烧杯中，水温为15℃～25℃，应迅速产生气体而成泡腾状，5分钟内颗粒均应完全分散或溶解在水中。颗粒剂按上述方法检查，均不得有异物，中药颗粒还不得有焦屑。混悬颗粒以及已规定检查溶出度或释放度的颗粒剂可不进行溶化性检查。膏药软化点（E错）：用于测定膏药在规定条件下受热软化时的温度情况以检测膏药的老嫩程度，并可间接反映膏药的黏性。照《中国药典》四部通则膏药软化点测定法检测，测定膏药因受热下坠达25mm时的温度的平均值，应符合规定。